男性，60岁，咳嗽5年，呼吸困难加重7天，桶状胸，X线示：肺透过度增强，肋间隙增宽，横膈下降，RV/TLC%=40%，MVV占预计值50%，FEV₁/FVC%为55%，该患者最恰当的诊断为
A. 代偿性肺气肿
B. 老年性肺气肿
C. 阻塞性肺气肿
D. 间质性肺气肿
E. 旁间隔性肺气肿

正确答案：C。阻塞性肺气肿

解析：主要根据吸烟等高危因素史、临床症状、体征及肺功能检查等综合分析而确定。不完全可逆性气流受限是COPD诊断的必备条件。不完全可逆性气流受限依据吸入支气管舒张药后FEV₁/FVC＜70%及FEV₁≥80%预计值可确定（C对）。代偿性肺气肿、老年性肺气肿、Down综合征中的先天性肺气肿等，临床也可以出现劳力性呼吸困难和肺气肿体征，但肺功能测定没有气流受限的改变，即FEV₁/FVC≥70%，与COPD不同（AB错）。气道压力过高或潮气量过大可致气压伤，如气胸、纵隔气肿或间质性肺气肿（DE错）。